DASH膳食富含的营养素是
A. 总脂肪
B. 饱和脂肪酸
C. 膳食纤维
D. 钠
E. 胆固醇

正确答案：C。膳食纤维

解析：本题考查DASH膳食富含的营养素。DASH膳食即高血压治疗膳食，由美国国立卫生研究院，美国心脏、肺和血液研究所制订。该膳食特点为富含水果、蔬菜，包括全谷类、家禽、鱼类、坚果，其富含的营养素有：钾、镁、钙和蛋白质（D错），而总脂肪（A错）、饱和脂肪酸（B错）、胆固醇（E错）含量较低，富含膳食纤维（C对）。